下课铃一响，几个校篮球队员便迫不及待地跑到操场上，分成两组，打起篮球。没打几分钟，周亮跳起投球，落地时摔倒了。好不容易站起来，右脚却不能动了，而且很痛。最可能发生的运动性损伤是
A. 骨折
B. 关节扭伤
C. 关节脱位
D. 肌肉拉伤
E. 挫伤

正确答案：B。关节扭伤